识记的内容遗忘最快发生在识记后的
A. 第1天
B. 第2天
C. 第3天
D. 第4天
E. 第5天

正确答案：A。第1天

解析：记忆的内容不能保持或提出时有困难称为遗忘。德国心理学家艾宾浩斯对遗忘规律做了首创性系统性研究，结果表明，学习后最初一段时间遗忘快，识记后的前9个小时遗忘速度最快（A对），随时间推移和记忆材料的数量减少，遗忘便渐渐缓慢，最后稳定在一定水平上。